修复体应达到的质量标准是
A. 足够的固位力，正确的外形、邻接及咬合关系
B. 边缘与患牙密合
C. 咬合力与牙周组织协调，能正确恢复口颌系统的功能
D. 应就位顺利，色泽自然美观，表面光洁、自洁作用好，无不良刺激
E. 以上均是

正确答案：E。以上均是

解析：本题考查修复体应达到的质量标准。为获得良好的修复体，修复体应达到的一定的质量标准，包括修复体有足够的固位力（A对）以防止修复体固位不良而脱位，正确的外形（A对）以满足患者的美观要求、正确的邻接及咬合关系（A对）以防止食物嵌塞以及咀嚼效率低下。修复体应达到的质量标准包括修复体边缘与患牙密合（B对）以防止食物嵌塞，减少继发龋的发生，保护基牙以及周围的牙龈。包括咬合力与牙周组织协调，保护牙周组织健康，能正确恢复口颌系统的功能（C对）。还应包括修复体就位顺利不损害基牙，就位后咬合高度合适，色泽自然美观，表面光洁、自洁作用好，无不良刺激（D对），对口腔组织无损害。（ABCD均对，故E为本题的正确答案）。